霍乱的主要治疗是
A. 扩容为主
B. 补液为主
C. 对症为主
D. 抗菌为主
E. 抗病毒为主

正确答案：B。补液为主

解析：霍乱治疗原则：严格隔离，及时补液（B对），辅以抗菌及对症治疗（C错）。